治疗尿血肾气不固者，应首选
A. 六味地黄丸
B. 十灰散
C. 小蓟饮子
D. 保真汤
E. 无比山药丸

正确答案：E。无比山药丸

解析：肾气不固证临床表现为久病尿血，血色淡红，伴头晕耳鸣，精神困惫，腰脊酸痛；舌质淡，脉沉弱。治宜补益肾气，固摄止血。方选无比山药丸（E对）。本方由熟地黄、山药、山茱萸、牛膝、肉苁蓉、菟丝子、杜仲、巴戟天、茯神、泽泻、五味子、赤石脂组成。若尿血较重者，加牡蛎、金樱子、补骨脂；腰脊酸痛、畏寒神怯者，加鹿角片、狗脊。六味地黄丸功用填精滋阴补肾，主治肾阴精不足证（A错）。十灰散功用凉血止血，主治血热妄行之上部出血证（B错）。小蓟饮子功效凉血止血，利水通淋，主治热结下焦之血淋、尿血（C错）。保真汤主治劳证骨蒸体虚（D错）。